腭裂手术修复的基本原则是
A. 封闭裂隙，延伸软腭长度
B. 将移位的组织结构复位
C. 减少手术创伤，妥善保留与腭部的营养和运动有关的血管、神经和肌的附着点，重建良好的腭咽闭合功能
D. 减少手术对颌骨发育的干扰
E. 以上均是

正确答案：E。以上均是

解析：本题考查腭裂手术修复的基本原则。腭裂整复手术是综合序列治疗中的关键部分，其主要目的是：恢复腭部的解剖形态；改善腭部的生理功能，重建良好的腭咽闭合功能，为患儿正常吸允、吞咽、语音、听力等生理功能恢复和创造必要条件。因此腭裂手术修复的基本原则应围绕其目的展开：封闭裂隙、保持和延伸软腭长度（A对），恢复软腭生理功能；将移位的组织结构复位（B对），以恢复腭部的解剖形态；减少手术创伤，妥善保留与腭部的营养和运动有关的血管、神经和肌的附着点，重建良好的腭咽闭合功能（C对）；同时应减少手术对颌骨发育的干扰（D对），保证颌骨健康发育。（ABCD均对，故E为本题的正确答案）。